患者，男，15岁。正畸需要减数拔牙，术中误将右下尖牙认为第一前磨牙拔除。根据上述情况，医师立即将误拔牙放入到原牙槽窝内，并适当固定，这种方法称为
A. 自体移植
B. 异体移植
C. 即刻再植
D. 延期再植
E. 牙种植术

正确答案：C。即刻再植

解析：本题考查牙槽外科。植牙术是恢复咀嚼、语音功能与面容的有效方法，包括牙再植、牙移植和牙种植三类。牙再植术，又分为即刻再植（C对）与延期再植（D错）；牙移植有自体移植（A错）和异体移植（B错）；牙种植术（E错）是指将人工材料制作的牙根种植在牙槽内的手术。牙再植术是将因种种原因脱位的牙经处理后，原位植入牙槽窝内。